外侧丘系传导
A. 痛觉信息
B. 温度觉信息
C. 触觉信息
D. 听觉信息
E. 本体感觉信息

正确答案：D。听觉信息

解析：外侧丘系传导听觉信息（D对）。外侧丘系参与听觉传导通路，该通路由二级神经元构成：听觉传导通路的第1级神经元为蜗神经节内的双极神经细胞，纤维交叉形成外侧丘系，交叉处纤维形成斜方体。